正确描述脊神经的是
A. 共30对
B. 由前根,后根在椎管外面合成
C. 出椎间孔立即分前、后两支
D. 只含有运动纤维和感觉纤维
E. 只分布到骨骼肌上

正确答案：D。只含有运动纤维和感觉纤维

解析：脊神经共31对（A错），前根和后根在椎间孔处合为一条脊神经（B错），由此成为既含感觉纤维又含运动纤维的混合神经（D对E错）。脊神经的前根和后根在椎间孔处合为脊神经后，立即分为4支。这些分支包括前支、后支、脊膜支和交通支（C错）。